血浆白蛋白的主要生理功能是
A. 具有很强结合补体和抗细菌功能
B. 维持血浆胶体渗透压
C. 白蛋白分子中有识别和结合抗原的主要部位
D. 血浆蛋白电泳时，白蛋白泳动速度最慢
E. 白蛋白可运输铁、铜等金属离子

正确答案：B。维持血浆胶体渗透压